某男，50岁。近来咳嗽不止，痰稠不易咳出。证属邪热伤肺，宜选用的药是
A. 瓜蒌
B. 枇杷叶
C. 芥子
D. 桑白皮
E. 白果

正确答案：A。瓜蒌

解析：本题考查的是瓜蒌的主治病证。近来咳嗽不止，痰稠不易咳出。证属邪热伤肺，宜选用的药是瓜蒌（A对）。瓜蒌：【主治病证】（1）肺热咳嗽、痰稠不易咳出。（2）胸痹，结胸。（3）乳痈肿痛，肺痈，肠痈。（4）肠燥便秘。枇杷叶（B错）：【主治病证】（1）肺热之咳喘痰稠。（2）胃热之烦渴、呕哕。芥子（C错）：【主治病证】（1）寒痰咳喘，悬饮胁痛。（2）痰阻经络之肢体关节疼痛，阴疽流注。桑白皮（D错）：【主治病证】（1）肺热之咳喘痰多。（2）浮肿尿少，小便不利。白果（E错）：【主治病证】（1）咳喘气逆痰多。（2）白浊，带下，尿频、遗尿。